流行性出血热早期低血压的主要原因是
A. 继发细菌感染
B. 小动脉痉挛
C. 高热汗出呕吐所致血容量下降
D. 严重腔道出血
E. 小血管通透性增加，大量血浆外渗

正确答案：E。小血管通透性增加，大量血浆外渗

解析：流行性出血热早期汉坦病毒能诱发机体的巨噬细胞和淋巴细胞等释放各种细胞因子和介质（如Ⅱ-1、TNF、前列腺素、内皮素等）会使小血管和毛细血管受到损害，引起血管通透性增加，血浆外渗使血容量下降，导致低血压休克，即原发性休克（E对）。